可加重出血从而延迟伤口愈合的抗肿瘤靶向药物是
A. 吉非替尼
B. 贝伐珠单抗
C. 阿达木单抗
D. 帕博利珠单抗
E. 索拉非尼

正确答案：B。贝伐珠单抗

解析：本题考查靶向治疗药物的临床应用注意事项。相比传统化疗药物，靶向药物在某些情况下存在显著优势，患者及家属往往抱有过高期待。但靶向药物也存在治疗失败的风险，可能会发生特殊或后果严重的不良反应，如吉非替尼可导致间质性肺炎，贝伐珠单抗（B对）加重出血从而延迟伤口愈合等。因此，应客观看待靶向药物的临床价值。